鼓室的外侧壁为
A. 颈静脉壁
B. 颈动脉壁
C. 鼓膜
D. 鼓室盖
E. 睫状体和巩膜交界处

正确答案：C。鼓膜

解析：颈静脉壁（A错）为鼓室下壁。颈动脉壁（B错）是鼓室前壁。鼓膜组成外侧壁的大部分，为鼓室外侧壁（C对）。鼓室盖（D错）为鼓室上壁。